水源加氟是一种有效的防龋手段，我国的水质标准氟浓度为
A. 0.05ppm以上～0.1ppm以内
B. 0.1ppm以上～0.5ppm以内
C. 0.5ppm以上～1ppm以内
D. 1ppm以上～5ppm以内
E. 5ppm以上～10ppm以内

正确答案：C。0.5ppm以上～1ppm以内

解析：本题考查我国的水质标准氟浓度。一般认为水中含氟量以1ppm为宜，该浓度既能有效防龋，又不致发生氟牙症。水氟的适宜浓度主要取决于当地的年平均最高气温，我国适宜浓度为0.5～1ppm（C对）。水氟浓度过高时，6～7岁以下儿童会出现严重的氟牙症，甚至影响全身骨骼的发育。水氟浓度过低时，无法提供适宜的氟，牙齿极易患龋。